牙齿的Ⅱ度松动，是指
A. 颊（唇）舌向松动
B. 近远中向松动
C. 颊（唇）舌向+近远中向松动
D. 垂直向松动
E. 颊（唇）舌向+近远中向+垂直向松动

正确答案：C。颊（唇）舌向+近远中向松动

解析：根据牙松动方向确定松动度：仅有颊舌向动度为Ⅰ度；颊（唇）舌向及近远中向均有动度为Ⅱ度；颊（唇）舌、近中远中和垂直均松动者为Ⅲ度。掌握“牙周疾病促进因素”知识点。